长期大量应用可促进蛋白质分解而导致骨质脱钙的药物是
A. 诺氟沙星
B. 泼尼松
C. 紫霉素
D. 美洛昔康
E. 头孢曲松

正确答案：B。泼尼松

解析：本题考查糖皮质激素的不良反应。长期大量应用可促进蛋白质分解而导致骨质脱钙的药物是泼尼松（B对）。泼尼松为糖皮质激素类药物，在影响钙盐吸收的同时还影响骨骼钙盐代谢，导致骨
质疏松、脱钙，严重者发生骨折，影响生长发育。诺氟沙星（A错）属于喹诺酮类抗生素，不良反应为肝肾毒性和可引起关节痛、关节肿胀及软骨损害，影响骨骼发育。紫霉素（C错）属于氨基糖苷类药物，主要不良反应为骨髓抑制和再生障碍性贫血。美洛昔康（D错）属于非甾体类抗炎药，不良反应为胃肠道反应。头孢曲松（E错）属于第三代半合成广谱头孢菌素，不良反应一般为恶心、腹泻，过敏反应有皮疹、瘙痒。